使微粒Zeta电位增加的电解质是
A. 助悬剂
B. 稳定剂
C. 润湿剂
D. 反絮凝剂
E. 絮凝剂

正确答案：D。反絮凝剂

解析：本题考查混悬剂。反絮凝剂（D对）能使微粒ζ（Zeta）电位升高，阻碍微粒之间的碰撞聚集，这个过程称为反絮凝。助悬剂（A错）是指能增加混悬剂中分散介质的黏度，降低药物微粒的沉降速度或增加微粒亲水性的附加剂。稳定剂（B错）是在混悬剂中起润湿、助悬、絮凝或反絮凝作用的附加剂。润湿剂（C错）是指能增加疏水性药物微粒被水润湿能力的附加剂。絮凝剂（E错）是指能使微粒ζ（Zeta）电位降低，产生絮凝作用的附加剂。